油条制作时因加碱及高温引起全部损失的维生素是
A. 维生素A
B. 硫胺素
C. 核黄素
D. 烟酸
E. 维生素C

正确答案：B。硫胺素